某患儿，女，5岁，低度发热，口咽部疼痛，口腔黏膜、牙龈、咽部、嘴唇，以及手和脚后跟边缘有无数水疱状病变。小水疱不含巨细胞或异常细菌。此病在7天后自愈，该患者最可能感染的病原体是
A. 麻疹病毒
B. 恙虫病立克次体
C. 水痘-带状疱疹病毒
D. 柯萨奇病毒
E. 单纯疱疹病毒

正确答案：D。柯萨奇病毒